灰交通支内含有
A. 副交感神经的节前纤维
B. 副交感神经的节后纤维
C. 交感神经的节后纤维
D. 交感神经的节前纤维
E. 交感神经和副交感神经的节后纤维

正确答案：C。交感神经的节后纤维

解析：灰交通支连于交感干与31对脊神经前支之间，由交感干神经节细胞发出的节后纤维组成（C对）。